一存活多年的同种异体肾移植接受者的体内虽有供体HLA人抗原表达却未发生明显的排斥反应，其原因可能是
A. 受者的免疫细胞功能活跃
B. 移植物的免疫细胞功能活跃
C. 移植物已失去了免疫原性
D. 受者对移植物发生了免疫耐受
E. 移植物对受者发生了免疫耐受

正确答案：D。受者对移植物发生了免疫耐受